妊娠期高血压的原因
A. 总外周阻力增加
B. 心输出量增加
C. 循环血量增加
D. 回心血量增加
E. 心指数增加

正确答案：A。总外周阻力增加

解析：妊娠期高血压的病因和发病机制尚未完全阐明，但基本病理生理变化是全身小血管痉挛和血管内皮损伤，从而导致的总外周阻力增加，血压升高（A对）。